胃术后低血糖综合征
A. 呕吐物为食物，无胆汁
B. 呕吐物为胆汁，无食物
C. 呕吐物既有胆汁，又有食物
D. 呕吐物呈酸臭味，有宿食
E. 无呕吐

正确答案：E。无呕吐

解析：胃术后低血糖综合征即晚期倾倒综合征，为食物进入肠道后刺激胰岛素大量分泌导致的反应性低血糖，主要表现为头晕、面色苍白、出冷汗、乏力等，无呕吐（E对）。呕吐物为食物，无胆汁（A错）为吻合口梗阻的临床表现，吻合口梗阻时，食物无法通过吻合口，胆汁可通过输出袢下行。呕吐物为胆汁，无食物（B错）为慢性不完全性输入袢梗阻的表现。呕吐物既有胆汁，又有食物（C错）为输出袢梗阻的临床表现。呕吐物呈酸臭味，有宿食（D错）为完全性幽门梗阻的临床表现，系因食物下行受阻，瘀滞在胃内发酵，在腹压升高时出现呕吐。